下列指标中哪一项是反映呼吸性酸碱平衡紊乱的重要指标？
A. pH
B. CO₂CP
C. PaCO₂
D. AB
E. BE

正确答案：C。PaCO₂

解析：pH（A错）只能初步判断是否为失代偿性酸中毒或失代偿性碱中毒，但不能判定是代谢性的还是呼吸性的。由于CO₂通过呼吸膜弥散快，PaCO₂相当于肺泡气CO₂分压，因此测定PaC02可了解肺泡通气量的情况，所以PaC02（C对） 是反映 呼吸性酸碱平衡紊乱的重要指标。标准碳酸氢盐(SB) （E错）是指全血在标准条件下测得的血浆中HCO₃⁻的量，由于标准化HCO₃⁻不受呼吸因素的影响，所以是判断代谢因素的指标。实际碳酸氢盐(AB) （D错）是指在隔绝空气的条件下测得的实际血浆HCO₃⁻浓度，受呼吸和代谢两方面的影响。